IgG与哪种补体结合
A. C9
B. C7
C. C1q
D. C3
E. C5

正确答案：C。C1q

解析：IgG主要是通过经典途径与C1q结合激活级联酶促反应过程(C对）｡